葡萄胎处理，下列哪项是错误的
A. 一经确诊，应尽快清宫
B. 必要时第2次刮宫
C. 宫腔内刮出物病理检查
D. 术后严密随访至妊娠试验（-）为止
E. 嘱患者术后避孕一年

正确答案：D。术后严密随访至妊娠试验（-）为止

解析：葡萄胎诊断一经成立，应尽快清宫（A对）；子宫大于妊娠12周或术中感到一次刮净有困难时，可于一周后行第二次刮宫（B对）；病理检查是葡萄胎的最终诊断依据，所以葡萄胎的宫腔内刮出物，必须送病理检查检查（C对），根据九版妇产科学：避孕时间为6个月（九版妇产科学P328）（E错）；定期hCG测定，葡萄胎清宫后每周一次，直至连续3次阴性，以后每个月一次共6个月，然后再每2个月一次共6个月，自第一次阴性后共计1年（D错，为本题正确答案）。